对半卡环适用于
A. 过长牙
B. 牙冠外形差的基牙
C. 远中孤立且有颊或舌向倾斜的磨牙
D. 孤立的双尖牙、磨牙
E. 松动的基牙

正确答案：D。孤立的双尖牙、磨牙

解析：本题考查对半卡环的适应证。对半卡环适用于孤立的双尖牙、磨牙，仅发挥卡抱作用，减轻对基牙的损伤（D对）。过长牙（A错）可用杆形卡环且美观，不显露金属。牙冠外形差的基牙（B错）可用延伸卡环来减轻基牙负担。远中孤立且有颊或舌向倾斜的磨牙（C错）可用圈形卡环。松动的基牙（E错）可用连续卡环，起到牙周夹板固定的作用。